重金属中毒时，不应该用的解救药品是
A. 二巯基丙醇（BAL）
B. 青霉胺（D-盐酸青霉胺）
C. 依地酸钙钠（解铅乐）
D. 亚甲蓝（美蓝）
E. 硫代硫酸钠（次亚硫酸钠）

正确答案：D。亚甲蓝（美蓝）

解析：本题考查重金属中毒解救。重金属中毒时，不应该用的解救药品是亚甲蓝（美蓝）（D错，为本题正确答案）。亚甲蓝（美蓝） 用于氰化物中毒，小剂量可治疗高铁血红蛋白血症（亚硝酸盐中
毒等）。二巯基丙醇（A对）用于砷、汞、金、铋及酒石酸锑钾中毒。青霉胺（B对）用于铜、汞、铅中毒的解救。依地酸钙钠（C对）用于铅、锰、铜、镉等中毒，尤以铅中毒疗效好，也可用于镭、钚、铀、钍中毒。硫代硫酸钠（次亚硫酸钠）（E对）主要用于氰化物中毒，也用于砷、汞、铅中毒等。